患者某牙已拔除4个月，局部愈合尚可，但有一骨嵴压痛明显，最佳处理方法是
A. 局部按摩
B. 观察，局部不进行处理
C. 舌系带延长术
D. 上颌结节修整术
E. 牙槽突修整术

正确答案：E。牙槽突修整术

解析：拔牙后牙槽骨吸收不全，骨尖、嵴有压痛者，应于拔牙后1个月以上进行修整。掌握“牙槽外科”知识点。